适当稀释后口服治疗上消化道出血的是
A. 肾上腺素
B. 去甲肾上腺素
C. 异丙肾上腺素
D. 多巴胺
E. 间羟胺

正确答案：B。去甲肾上腺素

解析：去甲肾上腺素（B对）对α受体有强大的激动作用，对β₁受体作用较弱，对β₂受体几乎无作用，可激动血管的α₁受体，血管收缩，稀释后口服，可收缩食道或胃局部黏膜血管，产生止血效果，可用于治疗消化道出血。肾上腺素（A错）属于α、β受体激动剂，加入局麻药注射液可延缓局麻药的吸收，减少中毒的可能性，同时延长局麻药的麻醉时间，还可用于鼻黏膜和齿龈出血，可将浸有0.1%2014U2-10%盐酸肾上腺素的纱布塞出血处。异丙肾上腺素（C错）属于β受体激动剂，临床可用于支气管哮喘、房室传导阻滞、心脏骤停。多巴胺（D错）主要激动α、β受体，临床主要用于治疗各种休克，如心源性休克、感染性休克和出血性休克，尤其适用于伴有心肌收缩力减弱、尿量减少的休克。间羟胺（E错）属于α受体激动剂，可直接兴奋α受体，对β₁受体作用较弱，临床可替代NA用于各种休克早期及手术后或脊柱麻醉后的休克。